腹壁下动脉
A. 髂内动脉的壁支
B. 与腹壁上动脉相吻合
C. 腹股沟疝与股疝的鉴别标志
D. 在腹直肌鞘外走行
E. 自腹股沟韧带下方发出

正确答案：B。与腹壁上动脉相吻合

解析：腹壁下动脉与腹壁上动脉吻合（B对）并分布于腹直肌。为髂外动脉在腹股沟韧带的稍上方（E错）发出。进入腹直肌鞘（D错）走行。